应在仓库中分开存放的是
A. 内服药与外用药
B. 麻醉药品
C. 二类精神药品
D. 化学药品危险品
E. 长期储存的怕压商品

正确答案：A。内服药与外用药

解析：本题考查药品储存要求。应在仓库中分开存放的是内服药与外用药（A对）。药品与非药品、外用药与其他药品分开存放，中药材和中药饮片分库存放。